对某病进行前瞻性研究时，最初选择的队列应由下列人员组成
A. 患该病的人
B. 未患该病的人
C. 具有欲研究因素的人
D. 具有该病家族史的人
E. 不具有欲研究因素的人

正确答案：B。未患该病的人

解析：本题考查前瞻性队列研究的对象。在前瞻性队列研究中，研究对象的分组是根据研究对象现时的暴露状况而定的，此时研究的结局还没有出现，需要前瞻观察一段时间才能得到。对某病进行前瞻性研究时，最初应选择未患该病的人（B对ACDE错）。